出现Aschoff细胞的是
A. 慢性肺源性心脏病
B. 高血压心脏病伴左心功能不全
C. 扩张性心肌病
D. 风湿性心脏病
E. 病毒性心肌炎

正确答案：D。风湿性心脏病

解析：Aschoff细胞也称风湿细胞，是由增生的巨噬细胞吞噬纤维素样坏死物质转变而成的，常出现于风湿性心脏病（D对）中。慢性肺源性心脏病（P177）（A错）主要出现特征性肺小动脉变化，如无肌型细动脉机化及肌型小动脉中膜增生、肥厚。高血压心脏病伴左心功能不全（B错）多引起肺淤血（P46），肺泡腔内可出现心衰细胞。扩张性心肌病（P149）（C错）主要出现心肌细胞不均匀性肥大、伸长，肥大和萎缩的心肌细胞交错排列。病毒性心肌炎（P153）（E错）主要出现心肌细胞间质水肿和心肌间质纤维化等。